若观察脱矿切片时，能够发现成牙本质细胞突起周围呈现一个环形的空隙，则空隙的结构被称为
A. 管间牙本质
B. 管周牙本质
C. 球间牙本质
D. 牙本质小管
E. 成牙本质细胞突起

正确答案：B。管周牙本质

解析：观察牙齿脱矿切片时，脱矿后管周牙本质的结构消失，故在成牙本质细胞突起周围呈现一处环形的空隙。掌握“牙本质”知识点。